患者近年来多次全身性强直阵挛发作，每次持续1～3分钟，阵挛停止后昏睡十余分钟，意识逐渐恢复，发作前胸腹有“气”上冲感。其诊断是
A. 癫痫大发作
B. 癫痫失神发作
C. 癫痫持续状态
D. 癫痫局限性发作
E. 癫痫精神运动性发作

正确答案：A。癫痫大发作

解析：患者近年来多次全身性强直-阵挛发作，每次持续1～3分钟，阵挛停止后昏睡十余分钟，意识逐渐恢复，发作前胸腹有“气”上冲感，符合全面性强直-阵挛发作的诊断标准，以往称大发作，为最常见的发作类型之一（A对）。癫痫失神发作（B错）的特点为意识短暂丧失，失去对周围的知觉，突然中止原来的活动或中断谈话，面色变白，双目凝视，手中所持物件可能失握跌落，有时眼睑、口角或上肢出现不易察觉的颤动，无先兆和局部症状。癫痫持续状态（C错）的特点为始终处于昏迷状态，随反复发作而间歇期越来越短，体温升高，昏迷加深。癫痫局限性发作（D错）发作时间较短，一般不超过1分钟，意识保持清醒，不失去对周围环境的知觉。癫痫精神运动性发作（E错）表现为各种类型的遗忘症、情感异常、错觉。